属于易燃易爆化学消毒剂的是
A. 乙醇
B. 苯扎溴铵
C. 次氯酸钙
D. 次氯酸钠
E. 过氧乙酸

正确答案：E。过氧乙酸

解析：本题考查易燃易爆化学消毒剂。过氧乙酸（E对ABCD错）是一种普遍使用的高效消毒剂，可迅速杀灭各种微生物，包括细菌、病毒、真菌和细菌芽孢。具有漂白作用，性质不稳定，易燃，遇热或有机溶剂、重金属离子、强碱等易分解。含量超过45%的高浓度溶液，经剧烈碰撞或加热可引起爆炸。